男，64岁。胸骨后烧灼样疼痛2周，伴嗳气，偶有吞咽不畅。口服奥美拉唑治疗2周后疼痛缓解。目前首选的检查是
A. 心电图
B. 冠状动脉造影
C. 胃镜
D. 24小时食管pH监测
E. 超声心动图

正确答案：C。胃镜

解析：老年男性患者胸骨后烧灼样疼痛伴嗳气（胃食管反流病常见临床表现），偶有吞咽不畅（多由食管痉挛或狭窄引起，提示可能存在食管器质性病变）。口服奥美拉唑治疗2周后疼痛缓解（应用抑酸剂后症状缓解，提示由胃酸原因导致的消化系统疾病可能性大）。结合上述病史和临床表现，该患者最有可能的诊断为胃食管反流病，胃镜（C对）是诊断此病最准确的方法。心电图（A错）多用于心脏方面的疾患尤其是心律异常的检查。冠状动脉造影（B错）多用于确诊冠心病。24小时食管pH监测（D错）也是用于诊断胃食管反流病的主要检查手段，主要通过食管PH值的变化评定是否存在反流，没有胃镜直观，故不作为首选检查。超声心动图（E错）多用于器质性心脏病的检查。